环磷酰胺属于哪一类抗肿瘤药
A. 金属络合物
B. 生物碱
C. 抗生素
D. 抗代谢物
E. 烷化剂

正确答案：E。烷化剂

解析：本题考查环磷酰胺。环磷酰胺属于烷化剂（E对）。烷化剂：如氮芥、环磷酰胺、塞替派、亚硝基脲类、氮甲（甲酰溶肉瘤素）。金属络合物（A错）：如顺铂、奥沙利铂。生物碱（B错）：如长春新碱、秋水仙碱、鬼臼毒素。抗肿瘤抗生素（C错）：丝裂霉素、博来霉素、放线菌素类等。抗代谢物（D错）：叶酸、嘧啶、嘌呤类似物等。